关于社区卫生服务的理解，下列错误的是
A. 以人的健康为中心
B. 以一二级预防为主
C. 以家庭为单位开展
D. 以区域卫生规划为指导
E. 服务方式是以三甲医院服务为主

正确答案：E。服务方式是以三甲医院服务为主

解析：社区卫生服务是在政府领导、社区参与、上级卫生机构指导下，以基层卫生机构为主体，全科医师为骨干，合理使用社区资源和适宜技术，以人的健康为中心（A对）、家庭为单位（C对）、社区为范围、需求为导向，以妇女、儿童、老年人、慢性病人、残疾人、贫困居民等为服务重点，以解决社区主要卫生问题、满足基本卫生服务需求为目的，融预防、医疗、保健、康复、健康教育、计划生育技术服务功能等为一体的，有效、经济、方便、综合、连续的基层卫生服务。由定义可以看出社区卫生服务以基层卫生机构为主体，而不是以三甲医院为主（E错，为本题正确答案）。